下述验证内容属于精密度的有
A. 定量限
B. 重复性
C. 重现性
D. 专属性
E. 中间精密度

正确答案：B、C、E。重复性；重现性；中间精密度